传染病在人群中发生流行的基本条件是
A. 传染源、传播途径、易感者三个基本环节
B. 必须有易感者的存在
C. 必须有传染源的存在
D. 必须有疫源地的存在
E. 病原体有机会侵犯机体

正确答案：A。传染源、传播途径、易感者三个基本环节